女，59岁。乏力伴心悸、多汗、手颤、易饿3个月，脾气暴躁。每天大便4～5次，不成形。体重下降6.0kg。查体：甲状腺Ⅱ度肿大、质软，心率110次/分，律齐，心音有力。该患者最可能的诊断是
A. 1型糖尿病
B. 溃疡性结肠炎
C. 2型糖尿病
D. 甲状腺功能亢进症
E. 更年期综合征

正确答案：D。甲状腺功能亢进症

解析：中年女性患者，出现乏力伴心悸、多汗、手颤、易饿、脾气暴躁、大便次数增多伴腹泻，体重下降（甲状腺功能亢进症典型症状）。甲状腺Ⅱ°肿大，心率快，心音有力（甲状腺功能亢进症典型体征），最可能的诊断为甲状腺功能亢进症（D对）。糖尿病（AC错）的典型临床表现为三多一少：即多尿、多饮、多食、体重减轻，血糖及尿糖升高，无甲状腺肿大及心悸、多汗、手颤等症状。溃疡性结肠炎（B错）有反复发作的腹泻、黏液血便和腹痛（P374），无甲状腺肿大及心悸、多汗、手颤等高代谢症候群。更年期综合征（E错）最典型的症状为潮热、潮红，一般无体重下降、大便次数增多、易饿及甲状腺肿大的表现。